可以取得广告批准文号，但只能在专业期刊进行广告宣传的药品是
A. 医疗机构制剂
B. 非处方药
C. 处方药
D. 第二类精神药品

正确答案：C。处方药

解析：本题考查的是处方药的广告管理。可以取得广告批准文号，但只能在专业期刊进行广告宣传的药品是处方药（C对）。处方药的广告管理：处方药只能在国务院卫生健康主管部门和国家药品监督管理局共同指定的专业性医药报刊（期刊）上进行广告宣传，不得在大众媒介上发布广告或以其他任何方式进行以个人消费者为对象的广告宣传。其目的是通过处方药广告的严格管理，防止个人消费者在缺乏医药专业知识背景下，获取处方药广告内容后可能产生消费误导，培养个人消费者对医药专业人员的信赖，使个人消费者能在医药专业人员全程介入下安全、正确地使用处方药。非处方药（B错）的广告管理：非处方药是方便个人消费者自我保健、治疗的药品，消费者应详细了解其治疗功效。因此，非处方药可以在大众媒介上进行广告宣传，但广告内容必须经过审查、批准，不能任意夸大或擅自篡改。其目的是正确引导个人消费者科学、合理地进行自我药疗。不得发布广告的产品：按照规定，不得做广告的产品包括：①麻醉药品、精神药品（D错）、医疗用毒性药品、放射性药品、药品类易制毒化学品，以及戒毒治疗的药品、医疗器械；②军队特需药品、军队医疗机构配制的制剂；③医疗机构配制的制剂（A错）；④依法停止或者禁止生产、销售或者使用的药品、医疗器械、保健食品和特殊医学用途配方食品；⑤法律、行政法规禁止发布广告的情形。